尿胆红素含量增加，尿胆原阴性提示黄疸类型
A. 溶血性黄疸
B. 肝细胞性黄疸
C. 胆汁淤积性黄疸
D. 肝癌性黄疸
E. 先天性非溶血性黄疸

正确答案：C。胆汁淤积性黄疸

解析：尿胆红素由血液中升高的结合胆红素被肾小球滤过膜滤过而产生；尿胆原是由肝细胞产生的结合胆红素在肠道中的细菌作用下转变而来，正常情况下，尿胆红素阴性，尿胆原阳性。尿胆红素含量增加，说明血液中结合胆红素增加；尿胆原阴性说明肠道中没有排入结合胆红素，提示胆汁排除受阻，黄疸类型为胆汁淤积性黄疸（C对）。溶血性黄疸（A错）尿胆原明显增加，尿胆红素阴性。肝细胞性黄疸（B错）尿胆原正常或轻度增加，尿胆红素阳性。肝癌性黄疸（D错）可表现为肝细胞性黄疸或胆汁淤积性黄疸。先天性非溶血性黄疸（P39）（E错）涉及黄疸类型较多，临床表现不一。